男，32岁。反复饥饿性上腹痛5年，疼痛多在餐前，进食后缓解，近段时间上腹痛加剧，并向背部放射。最可能的诊断是
A. 十二指肠球炎
B. 胃溃疡病
C. 复合性溃疡
D. 十二指肠球前壁溃疡
E. 十二指肠球后壁溃疡

正确答案：E。十二指肠球后壁溃疡

解析：中年男性患者，反复饥饿性上腹痛，进食后缓解（节律性上腹饥饿痛），符合十二指肠溃疡的典型症状，近期患者上腹痛加剧并向背部放射，可考虑患者为十二指肠球后壁溃疡（E对）。十二指肠球炎（A错）是十二指肠球部溃疡的先行阶段，腹痛程度轻，患者已出现上腹痛加剧症状，因此十二指肠溃疡的可能性高于十二指肠球炎。胃溃疡（P359）（B错）主要表现为餐后痛，1～2小时后缓解。复合性溃疡（C错）指胃和十二指肠均有活动性溃疡，典型者有轻度或中度剑突下持续疼痛。十二指肠球前壁溃疡（D错）疼痛通常位于中上腹部，较少放射至背部。